下列属于症的是
A. 嗳气
B. 食积
C. 热淋
D. 虚劳
E. 鼻渊

正确答案：A。嗳气

解析：本题考查的是症、证、病的概念。下列属于症的是嗳气（A对）。症，指疾病的外在表现，即症状。病，即疾病的简称，指有特定的致病因素、发病规律和病理演变的异常病变过程，具有特定的症状和体征。所谓“证”，是机体在疾病发展过程中某一阶段的病理概括，包括病变的部位、原因、性质以及邪正关系，能够反映出疾病发展过程中某一阶段的病理变化的本质，因而它比症状能更全面、更深刻、更准确地揭示出疾病的发展过程和本质。嗳气属于症，为不寐痰热扰心证的症状。不寐痰热扰心证：【症状】心烦不寐，胸闷脘痞，泛恶嗳气，伴口苦，头重，目眩。舌质偏红，苔黄腻，脉滑数。【治法】清化热痰，和中安神。【方剂应用】基础方剂为黄连温胆汤（半夏、茯苓、陈皮、甘草、枳实、竹茹、黄连、大枣）加减。【中成药应用】常用中成药有心速宁胶囊、礞石滚痰丸。食积（B错）、虚劳（D错）、鼻渊（E错）属于病。食积属于积滞。积滞，是指小儿内伤乳食，停聚中焦，积而不化，气滞不行所致的疾病，以脘腹胀满、嗳气酸腐、不思乳食、食而不化、大便溏薄或秘结酸臭为临床特征。西医学的小儿消化不良表现为上述症状者，可参考此内容辨证论治。虚劳又称虚损，是以脏腑亏损、气血阴阳虚衰，久虚不复成劳为主要病机，以五脏虚证为主要临床表现的多种慢性虚弱证候的总称。西医学中多个系统的多种慢性消耗性和功能衰退性疾病，出现类似虚劳的临床表现时，可参考此内容辨证论治。鼻渊，是以鼻流浊涕，量多不止为主要特征的鼻病。西医学的急、慢性鼻窦炎、鼻息肉、腺样体肥大等疾病有上述表现者，均可参考此内容辨证论治。热淋（C错）属于证，淋证热淋：【症状】小便频数短涩，灼热刺痛，尿色黄赤，少腹拘急胀痛，或有寒热，口苦，呕恶，或腰痛拒按，或大便秘结。舌质红，苔黄腻，脉滑数。【治法】清热利湿通淋。【方剂应用】基础方剂为八正散（车前子、瞿麦、萹蓄、滑石、山栀子仁、甘草、木通、大黄、灯心草）加减。【中成药应用】常用中成药有八正胶囊、复肾宁片、分清五淋丸。